下列不属于皮肤黏膜出血的是
A. 紫癜
B. 出血点
C. 血肿
D. 蜘蛛痣
E. 瘀斑

正确答案：D。蜘蛛痣

解析：蜘蛛痣是皮肤小动脉末端分支扩张所形成的血管痣，它是由一支中央小动脉及许多向外辐射的细血管组成，其向外延伸的细血管，统称为蜘蛛足（伪足），因形状似蜘蛛，故称为蜘蛛痣，不是皮肤黏膜出血（D错，为本题正确答案）。皮肤黏膜出血主要表现为皮肤黏膜的瘀点（B对）、紫癜（A对）、瘀斑（E对）及血肿（C对）。